影响栓子运行方向
A. 血栓部位
B. 血流方向
C. 血栓类型
D. 血栓大小
E. 血栓成分

正确答案：B。血流方向

解析：栓子一般随血流方向运行，最终停留在口径与其相当的血管并阻断血流。来自不同血管系统的栓子，其运行途径不同（B对）。